下列各项，属外科辨别阴证、阳证要点的是
A. 有无麻木
B. 有无脓液
C. 有无出血
D. 有无灼热
E. 有无瘙痒

正确答案：D。有无灼热

解析：中医外科疾病的阴阳辨证重点在于局部症状，表中辨别要点包括发病缓急，皮肤颜色，皮肤温度，肿胀形势，肿胀范围，肿块硬度，疼痛感觉，病位深浅，脓液质量，溃疡形色，病程长短，全身症状，舌苔脉象，预后顺逆。其中阳证局部皮肤焮热，阴证凉或不热（D对）。阴证与阳证都可产生脓液，脓液稠厚为阳证，脓液稀薄为阴证，不以有无脓液为阴证与阳证的辨别要点（B错）。麻木、出血、瘙痒，阴证阳证均可见，故不为其辨证要点（ACE错）。